长期使用β受体类药物治疗高血压，如果用药者需要停药应采取逐渐减量的方式。若突然停药或减量过快，则会引起原病情加重，这种现象称为
A. 精神依赖性
B. 药物耐受性
C. 身体依赖性
D. 反跳反应
E. 交叉耐药性

正确答案：D。反跳反应

解析：本题考查反跳现象。反跳反应（D对）是指长期服用某些药物，机体对这些药物产生适应性，若突然停药或减量过快易使机体的调节功能失调而发生功能紊乱，导致病情加重或临床症状上的一系列反跳回升现象。精神依赖性（A错）又称心理依赖性，是一种以反复发作为特征的慢性脑病，是指药物使人产生一种心满意足的愉快感觉，因而需要定期地或连续地使用它以保持那种舒适感或者为了避免不舒服。药物耐受性（B错）是指人体在重复用药条件下形成的一种对药物的反应性逐渐减弱的状态。身体依赖性（C错）又称生理依赖性，是指药物滥用造成机体对所滥用药物的适应状态。其特点是用药者一旦突然停止使用或减少用药用量，可产生一种强烈的症状或损害。人体的药物耐受性可能呈现交叉耐受性（E错）特征，即人体对某药产生耐受性后，亦可能表现出对其它化学结构类似或作用机制类似的同类药物的敏感性降低。